8岁男孩，浮肿，尿色红2天入院，查体：颜面眼睑浮肿，心肺听诊无异常，尿常规有红细胞（+++），蛋白（+），患儿半月前患过扁桃体炎。为明确诊断，最有意义的检查是
A. ASO与ESR
B. ASO与血浆蛋白电泳
C. ESR与补体C3
D. ESR与BUN
E. 血BUN与Cr

正确答案：C。ESR与补体C3

解析：8岁男孩，浮肿，尿色红2天入院，查体：颜面眼睑浮肿，心肺听诊无异常，尿常规有红细胞（+++），蛋白（+），患儿半月前患过扁桃体炎等表现提示该患儿可能患有急性肾小球肾炎，根据前期链球菌感染史，急性起病，具备血尿、蛋白尿、水肿等特点，急性期血清C3降低以及血沉加快等不难临床诊断此病，故为明确诊断，最有意义的检查是ESR与补体C3（C对）。而ASO（抗链球菌溶血素O）（AB错）由于前驱期的扁桃体炎感染史，往往增加，10～14天开始升高，3～5周时达高峰，3～6个月后恢复正常，可作为辅助诊断。血浆蛋白电泳（B错）常用于血清蛋白的测定，可作为肾综等的辅助诊断。BUN（血尿素氮）（DE错）升高常见于器质性肾功能损害、肾前性少尿、蛋白质分解或摄入过多及作为肾衰竭透析充分性指标，Cr（血肌酐）（E错）常用于评价肾小球滤过功能以及鉴别肾前性和肾实质性少尿等。